女，23岁。妊娠28周，尿糖阳性，OGTT空腹血糖正常，餐后1小时血糖升高。应该首先绐予的治疗是
A. 加强营养
B. 控制饮食
C. 胰岛素治疗
D. 口服降糖药物
E. 观察

正确答案：B。控制饮食

解析：(OGTT）诊断妊娠期糖尿病的标准为：空腹、服糖后1小时、服糖后2小时的血糖值分别≥5.1、10.0、8.5mmo/L， 任何一个时点血糖值达标，即可诊断为GDM。女，23岁，妊娠28周，尿糖阳性，OGTT空腹血糖正常，餐后1小时血糖升高诊断为妊娠期糖尿病。首先选择医学营养治疗，饮食控制很重要（B对）。大多数GDM孕妇通过生活方式的干预即可使血糖达标，不能达标的GDM患者首先推荐应用胰岛素控制血糖（ACDE错）。